流行病学的研究范围是
A. 传染病
B. 地方病
C. 传染病和地方病
D. 传染病和非传染病
E. 疾病和健康状况

正确答案：E。疾病和健康状况

解析：本题考查流行病学的研究范围。流行病学是研究人群中疾病与健康状况（E对ABCD错）的分布及其影响因素，并研究防制疾病及促进健康的策略和措施的科学。